某男，42岁。5年前诊断为糖尿病，经中西药治疗，病情得以控制。近日血糖有所升高，遂求中医诊治刻下多食善饥，每日需进食十余餐，餐后2小时左右便出现饥饿感，伴口渴多饮、乏力、小便频数而多、口苦咽干、舌质红、苔黄燥、脉细数。医生诊断为消渴病，证属阴虚火旺、津液被伤。处方：生石膏（先煎）30g，熟地黄10g，麦冬10g，知母10g，牛膝10g，柴胡5g，葛根10g，生甘草3g。根据口苦咽干、舌质红、苔黄燥、脉细数的病症特点处方中使用不当的中药是
A. 麦冬
B. 知母
C. 柴胡
D. 牛膝
E. 熟地黄

正确答案：C。柴胡

解析：本题考查的是柴胡的使用注意。根据口苦咽干、舌质红、苔黄燥、脉细数的病症特点处方中使用不当的中药是柴胡（C错，为本题正确答案）。口苦咽干、舌质红、苔黄燥、脉细数为阴虚的临床表现。阴虚证的临床表现，除见形体消瘦、口燥咽干、眩晕失眠、舌红脉细数等阴液不足的症状外，还常伴见五心烦热、潮热盗汗、舌红绛、脉数等阴不制阳、虚热内生的症状。柴胡：【使用注意】本品性能升发，故真阴亏损、肝阳上升之证忌服。麦冬（A对）：【使用注意】本品性凉滋润，故风寒或痰饮咳嗽、脾虚便溏者忌服。知母（B对）：【使用注意】本品性寒质滑，故脾胃虚寒、大便溏泻者忌服。牛膝（D对）：【使用注意】本品善下行逐瘀，故孕妇、月经过多及梦遗滑精者慎服。熟地黄（E对）：【使用注意】本品质黏滋腻，易碍消化，故脾胃气滞、痰湿内阻之脘腹胀满、食少便溏者忌服。